某女，34岁。妊娠8周，胎漏下血3天，又被蛇咬伤。宜选用的中药是
A. 棕榈炭
B. 鸡冠花
C. 白茅根
D. 侧柏叶
E. 苎麻根

正确答案：E。苎麻根

解析：本题考查苎麻根的主治病证。宜选用的中药是苎麻根（E对）。苎麻根【主治病证】（1）血热所致的各种出血证。（2）胎动不安，胎漏下血。（3）湿热淋痛，热毒疮肿，蛇虫咬伤。棕榈炭（A错）【主治病证】崩漏，便血，吐血，咳血，尿血。鸡冠花（B错）【主治病证】（1）吐血，崩漏，便血，痔疮出血。（2）赤白带下。（3）久痢不止。白茅根（C错）【主治病证】（1）血热之衄血、咳血、吐血、尿血。（2）热病烦渴，胃热呕哕，肺热咳嗽。（3）血淋，热淋，小便不利，水肿，湿热黄疸。侧柏叶（D错）【主治病证】（1）各种出血证。（2）肺热咳喘痰多。（3）血热脱发，须发早白。（4）烫伤（外用）。